患者，男，30岁，口角歪向右侧，左眼不能闭合2天，左侧额纹消失。治疗应选取何经穴为主
A. 手、足少阳经
B. 手、足太阴经
C. 手、足太阳经
D. 手、足厥阴经
E. 手、足阳明经

正确答案：E。手、足阳明经

解析：该患者的症状可知本病为面瘫，因风病多犯阳明，阳明为多气多血之经，阳明经气血通畅，正气得以扶助，使机体功能逐渐恢复，根据经脉循行路线，分别选取手足阳明经穴位，以达调和经脉，疏通气血的作用（E对）。